患者，女性，25岁，不明原因发热2个月入院，贫血貌，杵状指，皮肤黏膜有多处小出血点，入院时，三尖瓣区有Ⅲ级吹风样杂音，近日消失，脾大，有压痛，血液培养为草绿色链球菌，拟用青霉素G和下列之一药合用宜选用
A. 链霉素
B. 阿米卡星
C. 奈替米星
D. 红霉素
E. 羧苄西林

正确答案：A。链霉素